位于颊肌与咬肌之间的是
A. 眶下间隙
B. 颊间隙
C. 咬肌间隙
D. 颞下间隙
E. 颞间隙

正确答案：B。颊间隙

解析：颊间隙位于颊肌与咬肌之间，略呈倒立的锥形，前界为咬肌前缘，后界为下颌支前缘及颞肌前缘。掌握“面侧深区及颌面部各间隙的境界”知识点。